某女，73岁，素患咳嗽，近日加重，不得平卧，兼水肿、小便不利，证属痰塞肺实，宜选用的药是
A. 桔梗
B. 葶苈子
C. 紫菀
D. 紫苏子
E. 款冬花

正确答案：B。葶苈子

解析：本题考查的是葶苈子的主治病证。素患咳嗽，近日加重，不得平卧，兼水肿、小便不利，证属痰塞肺实，宜选用的药是葶苈子（B对）。葶苈子：【主治病证】（1）痰壅肺实之咳喘。（2）浮肿尿少，小便不利。桔梗（A错）：【主治病证】（1）咳嗽痰多、咯痰不爽，咽痛音哑。（2）肺痈胸痛、咳吐脓血、痰黄腥臭。紫菀（C错）：【主治病证】（1）外感咳嗽、咳痰不爽。（2）肺虚久咳、痰中带血。紫苏子（D错）：【主治病证】（1）痰壅咳喘气逆。（2）肠燥便秘。款冬花（E错）：【主治病证】多种咳嗽。